下列关于医疗机构药品采购管理和进货检查验收制度的说法，错误的是
A. 应当逐批验收购进药品，建立真实，完整的药品验收记录
B. 经药事管理与药物治疗学委员会审核同意，核医学科可以购用，调剂本专业所需的放射性药品
C. 留存的资料和销售凭证，应当按规定保存超过有效期1年，但不得少于2年
D. 个人设置的门诊部、诊所等医疗机构，不得配备常用药品和急救药品以外的其他药品

正确答案：C。留存的资料和销售凭证，应当按规定保存超过有效期1年，但不得少于2年

解析：本题考查药品生产、经营企业购销。药品生产、经营企业按照本条前款规定留存的资料和销售凭证，应当保存至超过药品有效期1年，但不得少于3年（C错，为本题正确答案）。购进药品应当逐批验收，并建立真实、完整的药品验收记录（A对）。经药事管理与药物治疗学委员会（组）审核同意，，核医学科可以购用、调剂本专业所需的放射性药品（B对）。个人设置的门诊部、诊所等医疗机构不得配备常用药品和急救药品以外的其他药品（D对）。